Pratt试验的目的是
A. 深静脉是否通畅
B. 检测交通静脉瓣膜功能
C. 检测血供是否充足
D. 检测桡骨茎突是否病变
E. 检测大隐静脉与深静脉交通瓣膜功能

正确答案：B。检测交通静脉瓣膜功能

解析：Pratt实验的目的是检测交通静脉功能（B对）。检测深静脉是否通畅（A错）的实验是Perthes实验。检测血供是否充足（C错）的实验是Buerger实验。检测桡骨茎突是否病变（D错）的实验是Finkelstein实验。检测大隐静脉与深静脉交通瓣功能（E错）的实验是Trendelenburg实验（主要反映隐-股静脉瓣膜功能）。